雌激素和孕激素作用的共同点是
A. 使子宫内膜腺体分泌
B. 使子宫内膜增生
C. 加强子宫输卵管平滑肌收缩
D. 减少宫颈粘液分泌
E. 促进乳腺发育

正确答案：E。促进乳腺发育

解析：雌激素和孕激素作用的共同点是促进乳腺发育（E对），其中雌激素促进乳腺导管发育，孕激素促进乳腺腺泡发育。使子宫内膜腺体分泌（A错）、减少宫颈黏液分泌（D错）是孕激素的生理作用（P20）。使子宫内膜增生（B错）、加强子宫输卵管平滑肌收缩（C错）是雌激素的生理作用（P20）。